依照《药品经营质量管理规范》，不符合药品零售企业药品陈列要求的情形有
A. 按药品的剂型或用途分类陈列
B. 药品与非药品分开陈列，内服药与外用药分开陈列
C. 处方药与非处方药分柜摆放
D. 拆零药品集中存放于拆零专柜
E. 麻醉药品、一类精神药品和毒性药品置专门的橱窗陈列

正确答案：E。麻醉药品、一类精神药品和毒性药品置专门的橱窗陈列

解析：本题考查的是药品零售企业药品陈列要求。零售企业不得经营麻醉药品、第一类精神药品（E错，为本题正确答案）。药品零售企业药品陈列要求：药品的陈列应当符合以下要求：按剂型、用途以及储存要求分类陈列（A对），并设置醒目标志，类别标签字迹清晰、放置准确；药品放置于货架（柜），摆放整齐有序，避免阳光直射；处方药、非处方药分区陈列（C对），并有处方药、非处方药专用标识；处方药不得采用开架自选的方式陈列和销售；外用药与其他药品分开摆放；拆零销售的药品集中存放于拆零专柜或者专区（D对）；第二类精神药品、毒性中药品种和罂粟壳不得陈列；冷藏药品放置在冷藏设备中，按规定对温度进行监测和记录，并保证存放温度符合要求；中药饮片柜斗谱的书写应当正名正字；装斗前应当复核，防止错斗、串斗；应当定期清斗，防止饮片生虫、发霉、变质；不同批号的饮片装斗前应当清斗并记录；经营非药品应当设置专区，与药品区域明显隔离（B对），并有醒目标志。